女，16岁。大学二年级学生。1年前和同学争吵后，便觉的同学都在议论她，常不怀好意地盯着她，甚至觉得有人跟踪她，想杀她。整天不敢出门，在屋里自言自语。该患者治疗有效的是
A. 氟哌啶醇
B. 碳酸锂
C. 地西泮
D. 丙米嗪
E. 异丙嗪

正确答案：A。氟哌啶醇

解析：16岁学生，1年前和同学争吵后，便觉的同学都在议论她，常不怀好意地盯着她，甚至觉得有人跟踪她，想杀她（被害妄想是精神分裂症的常见临床阳性症状）。整天不敢出门，在屋里自言自语（出现幻觉是精神分裂症的常见临床阳性症状），综上考虑诊断为精神分裂。氟哌啶醇（A对）对其有效。碳酸锂（B错）常用来治疗心境障碍。地西泮（C错）常用来治疗焦虑症及各种功能性神经症。丙米嗪（D错）常用来治疗抑郁症。异丙嗪（E错）是吩噻嗪类抗组胺药，也可用于镇吐、抗晕动以及镇静催眠。